迟发型超敏反应中最重要细胞是
A. B细胞
B. Mφ
C. Th1
D. Th2
E. 嗜碱粒细胞

正确答案：C。Th1

解析：Th1细胞通过产生IFN-1，激活巨噬细胞发动Ⅳ型超敏反应。掌握“B细胞、T细胞介导的免疫应答”知识点。